羊水过多的处理不正确的是
A. 胎儿畸形，应立即终止妊娠
B. 胎儿无畸形，孕妇症状较轻，妊娠不足37周者可继续妊娠
C. 吲哚美辛治疗
D. 高盐饮食
E. 必要时服用利尿剂及镇静剂

正确答案：D。高盐饮食

解析：羊水过多的治疗思路为胎儿有无畸形、孕周及孕妇自觉症状严重程度时处理羊水过多的关键。症状轻，胎儿无畸形，孕期不足37周，胎肺不成熟者，应尽可能延长孕周（B对），予以中西医结合保守治疗。若合并胎儿畸形，则应及时终止妊娠（A对），具体的治疗1.胎儿正常：低盐饮食（D错，为本题正确答案）、减少孕妇饮水量，左侧卧位卧床休息，改善子宫胎盘循环，预防早产。必要时用镇静剂和利尿剂，等待足月分娩（E对）。对于压迫症状严重，孕周小、胎肺不成熟者，可行经腹羊膜腔穿刺放羊水，以缓解症状。吲哚美辛（C对）可抑制胎儿排尿减少羊水量。2.胎儿异常：确诊胎儿畸形、染色体异常，应及时终止妊娠。